以疾病发展的自然过程为基础的、综合的、一体化的保健和费用支付体系称为
A. 健康维护计划
B. 病例管理
C. 疾病管理
D. 需求管理
E. 残疾管理

正确答案：C。疾病管理

解析：以疾病发展的自然过程为基础的、综合的、一体化的保健和费用支付体系即疾病管理（C对）。